妊娠期龈瘤好发于
A. 上颌双尖牙颊侧龈乳头
B. 下颌双尖牙颊侧龈乳头
C. 上颌磨牙颊侧龈乳头
D. 下前牙唇侧龈乳头
E. 下颌磨牙颊侧龈乳头

正确答案：D。下前牙唇侧龈乳头

解析：本题考查妊娠期龈瘤的好发部位。妊娠期龈瘤好发于下前牙唇侧龈乳头（D对）。妊娠期龈瘤发生于单个牙的牙龈乳头，前牙（尤其是下颌前牙）唇侧龈乳头较多见，多发生于个别牙排列不齐的龈乳头，通常始发于妊娠第3个月，迅速增大，色泽鲜红光亮或暗紫，表面光滑，质地松软，极易出血。瘤体常呈扁圆形向近远中扩延，有的呈小的分叶状，有蒂或无蒂。一般直径不超过2cm，但严重的可因瘤体较大而妨碍进食或被咬破而出血感染。分娩后能逐渐自行消失，有的患者还需手术切除。